脐以下腹前壁的深部淋巴管注入
A. 腹股沟深淋巴结
B. 腹股沟浅淋巴结
C. 髂外淋巴结
D. 腰淋巴结
E. 髂内淋巴结

正确答案：C。髂外淋巴结

解析：髂外淋巴结（C对）为脐以下腹前壁、膀胱、前列腺（男）或子宫颈和阴道上部（女）的深部淋巴管注入部位。